内耳是颞骨内呈盘卷状充满液体的管腔。内有感知位置觉和听觉的感受器，是前庭蜗器的功能中心结构。接受旋转运动起始和终止刺激的结构是
A. 球囊斑
B. 壶腹嵴
C. 螺旋器
D. 听弦
E. 椭圆囊斑

正确答案：B。壶腹嵴

解析：椭圆囊斑（A错）和球囊斑（E错）均属位觉感受器，感受头部静止的位置及直线变速运动引起的刺激。螺旋器（C错）是听觉感受器。壶腹嵴（B对）是位觉感受器，能感受头部旋转变速运动的刺激。